在体力劳动量不变的情况下，容易心梗发作的是
A. 稳定性心绞痛
B. 恶化性心绞痛
C. 变异性心绞痛
D. 初发型心绞痛
E. 梗死后心绞痛

正确答案：A。稳定性心绞痛

解析：同等体力活动下容易心梗发作的是稳定性心绞痛（A对），因为其诱发疼痛的因素在数月内无明显变化，所以在同样的体力活动下更容易发生。恶化性心绞痛（B错）和初发型心绞痛（D错）都属于不稳定性心绞痛，虽然也可因劳力活动诱发，但是诱发心绞痛的体力活动阈值较之前突然或持久降低。变异型心绞痛（C错）特征为静息心绞痛，无体力劳动或情绪激动等诱因。梗死后心绞痛（E错）心肌梗死后1个月内发生的不稳定型心绞痛。